最能确诊先天愚型的是
A. 智商的测定
B. 皮纹的检查
C. 脑电图的检查
D. 染色体核型分析
E. 特殊的面容

正确答案：D。染色体核型分析

解析：染色体核型分析（D对）是最能确诊先天愚型的确切证据。典型的先天愚型根据特殊面容（E错）、智商的测定（A错）、皮纹的检查（B错）等仅能做出临床判断。脑电图的检查（C错）多用于对癫痫的诊断和治疗评估。